肛管与直肠的连接处有一条不整齐的交界线，称为
A. 肛管直肠环
B. 齿线
C. 肛乳头
D. 肛门瓣
E. 肛柱

正确答案：B。齿线

解析：齿线（B对）：肛瓣与直肠柱的基底在直肠与肛管交界处形成的一条不整齐的交界线，齿线的上下组织结构明显不同，是临床上的重要标记线。肛管直肠环（A错）：由外括约肌浅部、深部围绕直肠纵肌及肛门内括约肌并联合肛提肌的耻骨直肠肌，环绕肛管直肠连接处所形成的肌环。肛乳头（C错）：直肠柱下端的三角形小隆起，沿齿线排列，有2～6个，表面灰白色，长不超过0.2cm，肛乳头由纤维结缔组织组成，含有血管和毛细淋巴管，表面覆以皮肤。肛瓣（D错）：各直肠柱下端之间借半月形的黏膜皱襞相连，这些半月形黏膜皱襞称为肛瓣，有6～12个，肛瓣是比较厚的角化上皮，它没有“瓣”的功能。肛柱（E错）：或称直肠柱，为肠腔内壁垂直的黏膜皱襞，有6～12个，长1～2cm，宽0.3～0.6cm，在儿童比较显著。